分布于上前牙腭侧牙龈及黏骨膜的神经是
A. 下牙槽神经
B. 上牙槽中神经
C. 上牙槽后神经
D. 鼻腭神经
E. 腭前神经

正确答案：D。鼻腭神经

解析：鼻腭神经麻醉区域：两侧尖牙腭侧连线前方的牙龈，腭侧粘骨膜和牙槽骨。尖牙腭侧远中部分因有腭前神经交叉分布，所以，该处不能获得完全的麻醉效果。必要时应辅以局部浸润麻醉或腭前神经阻滞麻醉。掌握“颌面部常用局麻法及牙拔除的麻醉选择”知识点。